男，30岁，头部外伤6小时，伤后有一过性意识障碍，3小时后再次出现昏迷。检查左颞部头皮血肿，左瞳孔散大。CT扫描显示左侧颞叶硬膜外血肿。颅内出血的来源是
A. 大脑前动脉
B. 大脑中动脉
C. 脑膜中动脉
D. 颞浅动脉
E. 枕动脉

正确答案：C。脑膜中动脉

解析：青年男性患者，头部外伤，伤后有一过性意识障碍，之后再次出现昏迷（硬膜外血肿的典型表现），检查左颞部头皮血肿，左瞳孔散大（左侧动眼神经麻痹的表现，提示左侧小脑幕切迹疝），CT扫描显示左侧颞叶硬膜外血肿，结合患者病史、临床表现和影像学检查，应诊断为左侧颞叶硬膜外血肿并小脑幕切迹疝。硬膜外血肿的主要来源是脑膜中动脉（C对）。大脑前动脉（A错）为颈内动脉的分支，主要供应脑实质而非脑膜，不会成为硬脑膜外血肿的来源。颞浅动脉（D错）、枕动脉（E错）为颈外动脉的分支，主要供应腮腺、颞区、顶部软组织而非硬脑膜，不会成为硬脑膜外血肿的来源。大脑中动脉（B错）出血多见于高血压脑病。